能引起皮肤癌的是
A. 联苯胺
B. 氯甲醚
C. 砷
D. 氯乙烯
E. 铬酸盐

正确答案：C。砷

解析：本题考查砷导致的皮肤癌。长期职业性砷（C对ABDE错）及其化合物暴露，可致手和脚掌有角化过度或蜕皮，典型的表现是手掌的尺侧缘、手指的根部有许多小的、角样或谷粒状角化隆起，俗称“砒疔”或“砷疔”，可融合成疣状物或坏死，继发感染形成经久不愈溃疡，可转变为皮肤原位癌。